急性化脓性腮腺炎最常见的病原菌是
A. 肺炎双球菌
B. 大肠埃希菌
C. 金黄色葡萄球菌
D. 链球菌
E. 变形杆菌

正确答案：C。金黄色葡萄球菌

解析：本题考查急性化脓性腮腺炎。急性化脓性腮腺炎最常见的病原菌是金黄色葡萄球菌（C对）。急性化脓性腮腺炎过去常见于腹部大手术以后，称为手术后腮腺炎。其病因主要为患者全身代谢紊乱、机体抵抗力低下或胃肠手术禁食后，反射性唾液功能降低，导致逆行感染，病原菌主要为金黄色葡萄球菌。